暂时性夹板固定注意事项错误的是
A. 应保持牙齿原来的位置，不可有牵拉移动力
B. 适用于牙列完整者
C. 结扎固定后无论有无咬合创伤都应进行充分地调（牙合）
D. 加强口腔卫生指导，严格控制菌
E. 不用固定牙咬硬物

正确答案：C。结扎固定后无论有无咬合创伤都应进行充分地调（牙合）

解析：本题考查暂时性夹板固定的注意事项。暂时性夹板固定用来暂时固定松动的患牙，促进牙周组织改建，减少牙齿松度。结扎固定后如果有咬合创伤应进行充分地调（牙合）以利于牙周组织修复，无咬合伤时则不必调（牙合）（C错，为本题的正确答案）。固定时应保持牙齿原来的位置不可有牵拉移动力（A对），否则会对牙周组织造成二次创伤。其适用于完整牙列患者（B对），有利于将松动牙齿与健康牙齿连接成一个咀嚼单位，以便分散咬合力，减轻松动（牙合）力。暂时性夹板固定时牙齿表面有固定的牙周夹板和钢丝，易积存食物和菌斑从而易引起龋病或牙周病，所以应加强口腔卫生，严格控制菌斑（D对）。固定牙处在牙周组织修复期，有一定的松动度，不可用固定牙咬硬物（E对），否则会引起继发性创伤，延缓牙周组织愈合。